张力性气胸的典型临床表现是
A. 缺氧性躁动
B. “Beck”三联征
C. 纵隔扑动
D. 重度或极度呼吸困难及广泛性皮下气肿
E. 反常呼吸

正确答案：D。重度或极度呼吸困难及广泛性皮下气肿

解析：本题考查气胸。张力性气胸的典型临床表现是重度或极度呼吸困难及广泛性皮下气肿（D对）。张力性气胸体格检查见伤侧胸部饱满，肋间隙增宽，呼吸幅度减低，可有皮下气肿。